没有咬合接触的是
A. 牙尖交错位
B. 下颌姿势位
C. 正中关系（牙合）
D. 前伸位
E. 下颌后退接触位

正确答案：B。下颌姿势位

解析：下颌姿势位曾称为息止颌位。当口腔在不咀嚼、不吞咽、不说话的时候，下颌处于休息状态，上下颌牙弓自然分开，从后向前保持着一个楔形间隙，称之为息止（牙合）间隙，一般为1～3mm。此时下颌所处的位置，称为下颌姿势位。掌握“下颌姿势位、三类颌位与前伸、侧方（牙合）颌位”知识点。